患者，男，70岁。急性心肌梗死，突发昏厥，心电图电活动无可辨认的QRS波群、ST段及T波，频率为400～450次/分。其诊断是
A. 心房纤颤
B. 窦性停搏
C. 室性心动过速
D. 心室扑动
E. 心室颤动

正确答案：E。心室颤动

解析：本例老年患者急性心肌梗死，突发昏厥，心电图无可辨认的QRS波群、ST段及T波，频率为400～450次/分，提示心室颤动（E对）。心房纤颤（A错）典型表现为第一心音强度变化不定、心律绝对不规整、脉搏短绌。心电图表现为P波消失，代之以小而规则的f波，频率约350～600次/分；心室率通常在100～160次/分；QRS波形态通常正常。窦性停搏（B错）心电图表现为在较正常PP间期显著长的间期内无P波发生，或P波与QRS波均不出现，长的PP间期与基本的窦性PP间期无倍数关系。室性心动过速（C错）心电图特征为3个或以上的宽大畸形的QRS波连续出现，ST2003U3-T波方向与QRS波主波方向相反，心室率通常为100～250次/分，心律规则。心室扑动（D错）呈正弦图形，波幅大而规则，频率150～300次/分。